女，43岁。近2周来发热，乏力，痰中带血，最高体温38℃，经“头孢菌素”抗感染治疗1周无效，查体，体温37.8℃，脉搏84次/分，左上肺语颤减弱，呼吸音低，实验室检查血常规，WBC7.8×10⁹/L，N0.73，L0.24。ESR43mm/h，胸部X线片示左上肺斑片状阴影，其内可见透亮区，该患者最可能的诊断是
A. 肺癌
B. 肺结核
C. 肺脓肿
D. 支气管扩张
E. 肺炎

正确答案：B。肺结核

解析：患者青年女性，近2周来发热，乏力，痰中带血，最高体温38℃（正常值36.0～37.0℃，提示低热），（肺结核常见全身中毒症状），经“头孢菌素”抗感染治疗1周无效（抗生素治疗对结核无效），查体：体温37.8℃（正常值36.0～37.0℃，提示低热），脉搏84次/分（正常值60～100次/分），左上肺语颤减弱，呼吸音低，实验室检查血常规，WBC7.8×10⁹/L（正常值4～10×10⁹/L），N0.73（正常值0.50～0.75），L0.24（正常值0.2～0.4）。ESR43mm/h（正常值：男性0～15mm/h，女性0～20mm/h），胸部X线片示左上肺斑片状阴影，其内可见透亮区（肺结核的典型胸片改变），根据其临床表现和辅助检查，考虑诊断为肺结核（B对）。肺癌（A错）多无急性感染中毒症状，有时痰中带血丝，血白细胞计数不高。肺脓肿（C错）临床特征为高热、咳嗽和咳大量脓臭痰，胸部X线影像显示有一个或多发的含气液平的空洞。支气管扩张（D错）多好发于儿童和青年，临床表现主要为慢性咳嗽、咳大量浓痰和（或）反复咳血，典型X线表现为“双轨征”。肺炎（E错）多起病急，临床表现多为咳嗽咳痰或原有呼吸道症状加重，可有呼吸困难，大多数有发热，早期肺部体征无明显异常。